关于哮病的叙述，正确的有
A. 是一种急性发作性疾病
B. 可分为急性发作期和缓解期
C. 发作与接触某些刺激物有关
D. 常在夜间时加重
E. 常在凌晨时缓解

正确答案：B、C、D。可分为急性发作期和缓解期；发作与接触某些刺激物有关；常在夜间时加重